牡丹皮的折断面呈
A. 颗粒状
B. 层片状
C. 平坦状
D. 纤维状
E. 角质状

正确答案：C。平坦状

解析：本题考查的是皮类药材的折断面。牡丹皮的折断面呈平坦状（C对）。皮类药材的折断面：皮类中药横向折断面的特征和皮的各组织的组成与排列方式有密切关系，因此是皮类中药的重要鉴别特征，折断面的性状特征主要有：（1）平坦状：有的皮类中药的组织中富有薄壁细胞而无石细胞群或纤维束，折断面较平坦，无明显突起物，如牡丹皮。（2）颗粒状（A错）：有的皮类中药的组织中富有石细胞群，折断面常呈颗粒状突起，如肉桂。（3）纤维状（D错）：有的皮类中药的组织中富含纤维，折断面多呈细的纤维状物或刺状物突出，如合欢皮。（4）层状：有的皮类中药的组织构造中的纤维束和薄壁组织呈环带状间隔排列，折断时形成明显的层片状（B错），如苦楝皮、黄柏等。有些皮的断面外层较平坦或颗粒状，内层显纤维状，说明纤维主要存在于韧皮部，如厚朴。有的皮类药材在折断时有细密、银白色、富弹性的橡胶丝相连，如杜仲。有的皮类药材在折断时有粉尘出现，这些皮的组织较疏松，含有较多的淀粉，如白鲜皮。断面角质状（E错）的药材有太子参、延胡索、白术、香附、百部等。